高热，既往胆囊切除史，39度，低血压，谵妄，黄疸，X线示胆总管及肝内外胆管扩张。反映病情危重的是
A. 皮肤黄疸
B. 发热
C. 谵妄休克
D. 腹痛
E. 低血压

正确答案：C。谵妄休克

解析：根据题干诊断考虑急性梗阻性化脓性胆管炎：多数病人有反复胆道感染病史或胆道手术史。本病除有急性胆管炎的Charcot三联征（腹痛、寒战高热、黄疸）外，还有休克、神经中枢系统受抑制表现，称为Reynolds五联征。本病发病急骤，病情进展迅速。皮肤黄疸、发热、腹痛属于一般临床表现，谵妄、休克比低血压更能反映病情危重（C对）。